根尖片投照的分角技术是指
A. X线与被检查牙齿的长轴垂直
B. X线与胶片垂直
C. X线与被检查牙齿的长轴及胶片之间的分角线垂直
D. X线与被检查牙齿的长轴和胶片之间的分角线平行
E. X线与咬合平面平行

正确答案：C。X线与被检查牙齿的长轴及胶片之间的分角线垂直

解析：本题考查根尖片投照的分角技术。X线平片为目前口腔医学临床应用最普遍的检查方法，包括根尖片、华特位片等。根尖片的投照技术包括根尖片分角线投照技术和根尖片平行投照技术。使用分角线技术投照时，X线中心线需要倾斜一定角度，使X线中心线与被检查牙的长轴和胶片之间的分角线垂直（C对D错）。根尖片平行技术投照时X线与被检查牙齿的长轴和胶片均垂直（AB错）。